类风湿性关节炎发作的高峰年龄在
A. 15岁以内
B. 6～15岁
C. 16～35岁
D. 36～45岁
E. 30～50岁

正确答案：E。30～50岁